女，21岁。午后发热伴胸闷、气短1周入院。胸部X线片示左侧胸腔积液（大量）。其气短的最主要原因是
A. 阻塞性通气功能障碍
B. 肺组织弥散功能障碍
C. 限制性通气功能障碍
D. 通气/血流比例失调
E. 动静脉分流

正确答案：C。限制性通气功能障碍

解析：患者为青年女性，胸部X片示左侧大量胸腔积液，导致左肺膨胀受限，纵膈右移，严重时也可影响右侧肺叶的呼吸运动，使肺活量减小，故其气短最主要的原因是限制性通气功能障碍（C对）（限制性通气障碍以肺流量减少为主，多出现于肺部无病变而胸廓活动度受限的病例，例如：肺间质纤维化，胸廓畸形，胸腔积液，胸膜增厚或肺切除术后）。阻塞性通气功能障碍（A错）是因为本身气管受阻或狭窄变得通畅度降低，例如：COPD等。肺组织弥散功能障碍（B错）见于肺气肿、弥散性肺间质病及其他肺组织病变等。通气/血流比例失调（D错）减少见于慢性气管炎，阻塞性肺气肿，肺水肿等，增大见于肺血栓栓塞，右心衰竭等。动静脉分流（P137）（E错）是指肺动脉的静脉血未经氧合直接流入肺静脉，导致PaO₂降低，是通气/血流比例失调的特例，常见于肺动-静脉瘘。